不是由A群链球菌引起的疾病是
A. 亚急性感染性心内膜炎
B. 猩红热
C. 风湿热
D. 急性肾小球肾炎
E. 蜂窝织炎

正确答案：A。亚急性感染性心内膜炎